激活糜蛋白酶原的是
A. 肠致活酶
B. 胰蛋白酶
C. 盐酸
D. 组胺
E. 辅酶

正确答案：B。胰蛋白酶

解析：胰蛋白酶和糜蛋白酶都以无活性的酶原形式存在于胰液中，肠液中的肠激酶（A错）是激活胰蛋白酶原的特异性酶。糜蛋白酶原主要在胰蛋白酶（B对）的作用下转化为有活性的糜蛋白酶。盐酸（C错）可激活胃蛋白酶原，使其活化为胃蛋白酶。组胺（D错）可以刺激胃酸的分泌，与辅酶（E错）都没有活化糜蛋白酶原的作用。